亚稳定型（A）与稳定型（B）符合线性动力学，在相同剂量下，A型/B型分别为99:1，10:90，1:99对应的AUC为1000㎍·h/ml、550㎍·h/ml、500㎍·h/ml，当AUC为750㎍·h/ml，则此时A/B为
A. 25∶75
B. 50∶50
C. 75∶25
D. 80∶20
E. 90∶10

正确答案：B。50∶50

解析：本题考查曲线下面积。根据AUC=C₀/k和AUC=AUC（A）+AUC（B）,列方程组：99/ka+1/kb=1000，1/ka+99/kb=500，解得1/ka=10.05，1/kb=4.95。设A为x，B为100-x时，AUC=750，即10.05x+4.95×（100-x）=750，解得x=50，故当AUC为750㎍·h/ml，则此时A/B为50∶50（B对）。